流行性出血热的病理变化主要涉及
A. 肺部、胃肠系统、神经系统、皮肤黏膜、眼部
B. 肺部、循环系统、神经系统、皮肤黏膜、眼部
C. 血管、肾脏、心脏、脑垂体
D. 肝、肾、神经、皮肤黏膜
E. 全身各脏器

正确答案：C。血管、肾脏、心脏、脑垂体

解析：流行性出血热，即肾综合征出血热，以出血、休克和肾脏损害为主要特征（C对ABDE错）：①出血：出血是由于血管壁受损和血小板减少或功能异常所致，休克以后出血加重主要与DIC导致的凝血机制异常相关。②休克：原发性休克的主要原因是血管通透性增加，血浆外渗于组织中，有效循环血容量下降。由于血浆外渗，促使血液黏稠度升高和DIC，进一步加重了有效血容量的不足。继发性休克主要与大出血继发感染和多尿期水、电解质的失衡导致有效血容量不足有关。③急性肾功能衰竭：表现为皮肤、黏膜和各系统组织器官广泛充血、出血、严重渗出和水肿，多数器官组织和实质细胞有凝固性坏死，以肾髓质、脑垂体前叶、肝小叶中间带和肾上腺皮质最常见，在病变处可见到单核细胞和浆细胞浸润。